不属于僵蚕性状鉴别特征的是
A. 呈圆柱形、多弯曲皱缩
B. 表面有白色粉霜状的气生菌丝和分生孢子
C. 足4对，体节不明显
D. 质硬而脆，断面平坦
E. 气微腥，味微咸

正确答案：C。足4对，体节不明显

解析：本题考查的是僵蚕药材的性状鉴别。僵蚕足8对，体节明显（C错，为本题正确答案）。僵蚕：【性状鉴别】药材略呈圆柱形，多弯曲皱缩（A对）。表面灰黄色，被有白色粉霜状的气生菌丝和分生孢子（B对）。头部较圆，足8对，体节明显，尾部略呈二分歧状。质硬而脆，易折断，断面平坦（D对），外层白色，中间有亮棕色或亮黑色丝腺环4个。气微腥，味微咸（E对）。